使用糖皮质激素，可能引起多种不良反应和并发症。关于糖皮质激素类药物的不良反应属于骤停后容易出现的不良反应是
A. 消瘦
B. 骨质疏松症、白内障
C. 肾上腺皮质功能不足症状
D. 情绪不稳定、失眠
E. 溃疡性结肠炎

正确答案：C。肾上腺皮质功能不足症状

解析：本题考查糖皮质激素的不良反应。使用糖皮质激素骤停之后容易出现肾上腺皮质功能不足症状（C对）。